除好发于下颌第三磨牙区外，上颌尖牙区也是好发部位的是
A. 含牙囊肿
B. 根端囊肿
C. 始基囊肿
D. 皮样囊肿
E. 甲状舌管囊肿

正确答案：A。含牙囊肿

解析：含牙囊肿除下颌第三磨牙区外，上颌尖牙区也是好发部位。掌握“牙源性颌骨囊肿”知识点。